溴新斯的明的化学名是
A. 溴化-N，N，N-三甲基-2-[（二甲氨基）甲酰氧基]苯胺
B. 溴化-N，N，N-三甲基-2-[（二甲氨基）甲酰基]苯胺
C. 溴化-N，N，N-三甲基-3-[（二甲氨基）甲酰基]苯胺
D. 溴化-N，N，N-三甲基-3-[（二甲氨基）甲酰氧基]苯胺
E. 溴化-N，N，N-三甲基-2-[（二甲氨基）甲酰氧基]苯胺

正确答案：D。溴化-N，N，N-三甲基-3-[（二甲氨基）甲酰氧基]苯胺